患者女性9岁，因上唇外伤性缺损行下唇组织瓣转移修复上唇缺损，其组织瓣成活后断蒂的时间为
A. 术后1周
B. 术后3周
C. 术后10天
D. 术后1个月
E. 术后2个月

正确答案：B。术后3周

解析：本题考查组织瓣成活后断蒂的时间。皮瓣移植是目前应用最多的自体组织移植方法之一，皮瓣必须有与机体皮肤相连的蒂，或行血管吻合，血液循环重建后供给皮瓣血供和营养，才能保证移植皮瓣成活。因此该患者下唇组织瓣转移修复上唇缺损，其组织瓣成活后断蒂的时间为2周～3周（B对）。断蒂的时间过短（AC错），组织瓣尚未完全成活，转移的组织瓣容易因失血而死亡导致移植失败；断蒂的时间过长（DE错）则不利于下唇愈合，会形成较重的瘢痕组织。